治肺痈胸痛、咳吐脓血、痰黄腥臭之证，应选用
A. 桔梗
B. 半夏
C. 昆布
D. 白芥子
E. 白附子

正确答案：A。桔梗

解析：本题考查的是桔梗的主治病证。治肺痈胸痛、咳吐脓血、痰黄腥臭之证，应选用桔梗（A对）。桔梗：【主治病证】（1）咳嗽痰多、咯痰不爽，咽痛音哑。（2）肺痈胸痛、咳吐脓血、痰黄腥臭。半夏（B错）：【主治病证】（1）痰多咳喘，痰饮眩悸，风痰眩晕，痰厥头痛。（2）胃气上逆，恶心呕吐。（3）胸脘痞闷，梅核气，瘿瘤痰核，痈疽肿毒。昆布（C错）：【主治病证】（1）瘰疬，瘿瘤。（2）脚气浮肿，水肿，小便不利。白芥子（D错）即芥子。芥子：【主治病证】（1）寒痰咳喘，悬饮胁痛。（2）痰阻经络之肢体关节疼痛，阴疽流注。白附子（E错）：【主治病证】（1）中风痰壅，口眼㖞斜，破伤风，惊风癫痫，偏正头痛。（2）毒蛇咬伤，瘰疬痰核。